属于射线灭菌法的是
A. 热压灭菌法
B. 流通蒸汽灭菌法
C. 火焰灭菌法
D. 微波灭菌法
E. 气体灭菌法

正确答案：D。微波灭菌法

解析：本题考查射线灭菌法。射线灭菌法包括辐射灭菌法、紫外线灭菌法、微波灭菌法（D对）。